慢性放射病最常见的改变是
A. 神经系统
B. 造血系统
C. 内分泌系统
D. 心血管系统
E. 生殖系统

正确答案：B。造血系统